在环境化学污染物中，一次污染物是指
A. 从污染源排入环境后，理化特性发生了变化的污染物
B. 从污染源直接排入环境，理化特性未发生变化的污染物
C. 从污染源排入环境后，其毒性增大的污染物
D. 多个污染源同时排出的同一类污染物
E. 多种环境介质中都存在的同一类污染物

正确答案：B。从污染源直接排入环境，理化特性未发生变化的污染物

解析：本题考查一次污染物。在环境化学污染物中，一次污染物是指从污染源直接排入环境，理化特性未发生变化的污染物（B对）；从污染源排入环境后，理化特性发生了变化的污染物（A错）是二次污染物。